呕吐吞酸，胸肋胀满
A. 外邪犯胃
B. 饮食停滞
C. 痰饮内阻
D. 肝气犯胃

正确答案：D。肝气犯胃

解析：本题考查中医辨证。呕吐吞酸，胸肋胀满为肝气犯胃（D对）。肝胃不和证的临床表现及辨证要点：肝胃不和证的临床表现，常见胸胁胀满，善太息，胃脘胀满作痛，嗳气吞酸，嘈杂或呕恶，苔薄黄，脉弦。肝郁气滞，故胸胁胀痛、善太息。肝气犯胃，胃失和降，故嗳气、吞酸、嘈杂、呕恶。胃脘胀满作痛为气滞疼痛的特点，亦由肝气犯胃所致。一般以脘胁胀痛、吞酸嘈杂为辨证要点。气逆证【证候分析】肺气上逆，多因感受外邪或痰浊壅滞，肺气不能宣发肃降，上逆而发咳嗽、喘息。胃气上逆，由寒饮、痰浊、食积等停留于胃，阻滞气机或外邪犯胃（A错），使胃失和降，上逆而为呃逆、嗳气、恶心、呕吐。肝气上逆多因郁怒伤肝，肝气升发太过，气火上逆而见头痛、眩晕、昏厥；血随气逆而上涌，可致呕血。食滞胃肠证【证候分析】饮食停滞（B错）胃脘，胃失和降，气机不畅，故胃脘胀闷疼痛、拒按；胃中腐浊之气上逆，则嗳腐吞酸，或呕吐酸腐食物；吐后气机暂时舒通，故吐后胀痛得减；食积于内，拒于受纳，故厌食；食滞下移肠道，阻塞气机，故肠鸣矢气、便溏、泻下物酸腐臭秽。舌苔厚腻、脉滑为食积之征象。饥不欲食：是指病人有饥饿感，但不想进食或进食不多。常见于胃阴不足（E错）的病人。临床表现为饥不欲食，胃中有嘈杂、灼热感，舌红少苔，脉细数，是因胃阴不足，虚火内扰所致。此外，蛔虫内扰亦可见此症。